属前体药物，在体内代谢后产生活性的药物是
A. 氯吡格雷
B. 华法林钠
C. 奥扎格雷
D. 西洛他唑
E. 替罗非班

正确答案：A。氯吡格雷

解析：本题考查氯吡格雷。氯吡格雷（A对）为前药，必须经肝酶和脂酶代谢产生活性成分与血小板P2Y12受体结合，才能发挥抗血小板作用。华法林钠（B错）为口服维生素K拮抗药。奥扎格雷（C错）为血栓烷（TX）合酶抑制剂。西洛他唑（D错）为磷酸二酯酶-3抑制剂。替罗非班（E错）竞争性抑制纤维蛋白原和血小板GPⅡb/Ⅲa受体的结合，抑制血小板聚集。以上四种均不是前药。